女，68岁。近3个月来常有粘液血便，大便次数增多，有肛门坠胀及里急后重感，大便变细，上述症状进行性加重，查体：生命征平稳，腹部无明显阳性体征血、血、尿常规均正常。首选的检查应是
A. 乙状结肠镜
B. 腹部B超
C. 腹部CT
D. 直肠指诊
E. 钡灌肠

正确答案：D。直肠指诊

解析：患者有肛门坠胀及里急后重感（直肠刺激症状），大便次数增多（排便习惯改变），大便变细并呈进行性加重（符合直肠癌典型症状），应该考虑为直肠癌。直肠指诊是诊断直肠癌最重要的诊断方法，首选的检查应是直肠指诊（D对）。乙状结肠镜操作较为复杂，一般用于直肠指诊有阳性结果后，取活检组织时采用（A错）。直肠属空腔器官，气体较多，腹部B超不适用（B错）。腹部CT（C错）主要用于了解肿块大小、形态及有无盆腔肝脏转移。钡灌肠（E错）对于结肠及小肠部位有一定诊断价值，对直肠癌意义不大。